不能用于液体药剂矫味剂的是
A. 泡腾剂
B. 消泡剂
C. 芳香剂
D. 胶浆剂
E. 甜味剂

正确答案：B。消泡剂

解析：本题考查液体制剂常用的附加剂。消泡剂（B错，为本题正确答案）不能用于液体药剂矫味剂。消泡剂是指可以降低表面张力，抑制泡沫产生或消除已产生泡沫的辅料。矫味剂分为泡腾剂（A对）、芳香剂（C对）、胶浆剂（D对）、甜味剂（E对）。